关于带铜V型宫内节育器，错误的是
A. 是我国常用的宫内节育器之一
B. 其形状更接近宫腔形态
C. 带器妊娠率低
D. 出血发生率低
E. 脱落率低

正确答案：D。出血发生率低

解析：带铜V型宫内节育器是我国常用的宫内节育器之一（A对）。IUD呈V形状，类似上宽下窄的子宫腔（B对），其带器妊娠率低（C对）、脱落率低（E对），因其出血发生率高（D错，为本题正确答案）导致取出率较高。